强酸性阳离子交换树脂的离子交换基团是
A. —SO3，— H+
B. —C00，—H+
C. —N+（CH3）3C—
D. —NH2
E. RP—18

正确答案：A。—SO3，— H+